伤寒最严重的并发症是
A. 肠穿孔
B. 心肌炎
C. 肠出血
D. 中毒性肝炎
E. 肺炎

正确答案：A。肠穿孔

解析：伤寒常见并发症：（一）肠出血（C错）：肠出血为常见的严重并发症。多出现在病程第2-3周，大量出血时，常表现为体温突然下降，头晕、口渴、恶心和烦躁不安等症状。（二）肠穿孔：肠穿孔为最严重的并发症（A对）。发生率为1%-4%。常发生于病程第2-3周，穿孔部位多发生在回肠末段，成人比小儿多见。（三）中毒性肝炎（D错）：中毒性肝炎常发生在病程第1-3周。发生率为10%-50%。体检可发现肝脏肿大和压痛。血清丙氨酸氨基转移酶（ALT）轻至中度升高，仅有部分患者血清胆红素轻度升高，发生肝功能衰竭少见。（四）中毒性心肌炎（B错）：中毒性心肌炎常出现在病程第2-3周。患者有严重的毒血症状，主要表现为脉搏增快、血压下降，第一心音低钝、心律失常。心肌酶谱异常。心电图检查可出现P-R间期延长、ST段下降或平坦、T波改变等异常。（五）其他并发症：其他并发症包括支气管炎及肺炎（E错）、溶血性尿毒综合征、急性胆囊炎、骨髓炎、肾盂肾炎、脑膜炎和血栓性静脉炎等。